胃痛的治疗，主要是
A. 调肝理气止痛
B. 调肝和胃止痛
C. 理气和胃止痛
D. 调理脾胃止痛
E. 调肝理脾止痛

正确答案：C。理气和胃止痛

解析：胃痛的治疗原则当与其病因病机相符合，胃痛的发生，主要由外邪犯胃、饮食伤胃、情志不畅和脾胃素虚等，其总的病机均为胃气郁滞，胃失和降，不通则痛，故治疗当理气和胃止痛（C对）。调肝理气止痛用于肝郁气滞而痛（A错）。调肝和胃止痛用于肝胃不和而痛（B错）。调理脾胃止痛用于脾胃虚弱而痛（D错）。调肝理脾止痛用于肝脾不调，且肝脾不调不导致胃痛（E错）。